对鼓膜的描述，错误的是
A. 是外耳的一部分
B. 在位于外耳道与鼓室之间
C. 在成人它与外耳道下壁呈45度角
D. 光锥是自鼓膜脐向后下方的一个三角形反光区
E. 无

正确答案：D。光锥是自鼓膜脐向后下方的一个三角形反光区

解析：外耳包括耳郭、外耳道和鼓膜3 部分（A对）。鼓膜位于外耳道与鼓室之间（B对），与外耳道底形成约45°~ 50° 的倾斜角（C对）。鼓膜下3/4 区，坚实紧张，为紧张部，活体呈灰白色，紧张部前下方有一三角形的反光区，称光锥 （D错，为本题正确答案）。